男，44岁，因发热、胸痛伴心包摩擦音，曾用非激素类抗炎药。2周后，呼吸困难加重，心率110次/分，律齐，心音遥远，血压90/70mmHg。肝脏肿大，下肢浮肿。病人还存在具有诊断价值的体征是
A. 水冲脉
B. 交替脉
C. 奇脉
D. 重搏脉
E. 短绌脉

正确答案：C。奇脉

解析：患者中年男性，有发热胸痛症状并伴心包摩擦音，提示有急性心包炎；近来呼吸困难加重，心音遥远（心包积液常见体征），肝脏肿大，下肢浮肿（体循环淤血表现），考虑患者由于急性心包炎发展为心脏压塞。当出现心脏压塞时，吸气时一方面右心室舒张功能受限，回心血量减少影响右心排血量；另一方面受吸气时胸腔负压的影响，肺血管扩张，回流左心的血液量减少，左室排血也减少，这些因素形成吸气时脉搏减弱，甚至不能触及，即为奇脉（C对）。水冲脉（A错）常见于甲亢、主动脉瓣关闭不全等疾病。交替脉（B错）为左室心力衰竭的重要体征之一，常见于高血压性心脏病、急性心肌梗死和主动脉瓣关闭不全导致的心力衰竭等。重搏脉（D错）指正常脉波在其下降期中有一重复上升的脉波，但较第一个波为低，不能触及，在某些病理情况下，此波增高而可以触及，即一个收缩期可触及两个脉搏搏动。常见于肥厚型梗阻性心肌病和长期发热患者。短绌脉（P188）（E错）指脉率小于心率，为心房颤动的典型体征。